男，30岁。反复排黏液血便3年，加重2个月。抗生素治疗无效。肠镜示：直肠至结肠脾曲黏膜弥漫性充血水肿，较多糜烂及表浅小溃疡。最可能的诊断是
A. 溃疡性结肠炎
B. 克罗恩病
C. 细菌性痢疾
D. 阿米巴痢疾
E. 肠结核

正确答案：A。溃疡性结肠炎

解析：中青年男性，反复排黏液血便（黏液脓血便是溃疡性结肠炎活动期的重要表现）3年，加重2个月。抗生素治疗无效（用于鉴别细菌性痢疾）。肠镜：直肠至结肠脾曲（溃疡性结肠炎的好发部位）黏膜弥漫性充血水肿，较多糜烂及表浅小溃疡（溃疡性结肠炎的结肠镜特点为：溃疡浅，黏膜弥漫性充血水肿、颗粒状，脆性增加）。综合该患者的病史及结肠镜检查，考虑诊断为溃疡性结肠炎（A对）。克罗恩病（P377）（B错）好发于回肠末段，临床以腹痛、腹泻、体重下降、腹块、瘘管形成和肠梗阻为特点，结肠镜检查可见纵行溃疡和裂隙溃疡、鹅卵石征，病变间的黏膜正常。细菌性痢疾（C错）可有黏液脓血便，但抗生素治疗有效，结肠镜检查可见地图状溃疡。阿米巴痢疾（八版传染病学P274）（D错）有黏液脓血便，粪质较多并有腥臭，结肠镜检查常见大小不等的散在溃疡，中心有渗出，边缘整齐并有周边红晕。肠结核（P368）（E错）好发于回盲部，常有结核毒血症状，无脓血便，结肠镜检查可见溃疡呈带状，长径与肠轴垂直。